其性升散的邪气是
A. 燥邪
B. 暑邪
C. 风邪
D. 寒邪
E. 湿邪

正确答案：B。暑邪

解析：暑性升散，易伤津耗气（B对）。燥性干涩，易伤津、伤肺（A错）。风为百病之长，主动，善行而数变，轻扬开泄、易袭阳位（C错）。寒邪性收引、凝滞，易伤阳气（D错）。湿为重浊之邪，属阴，其性重浊、黏滞，易伤阳气，易阻气机，易袭阴位（E错）。